男婴，2个月。生后4周出现呕吐，有时呈喷射性，多发生于喂奶后半小时内，呕吐物不含胆汁，吐后食欲好，体重明显下降。最可能的诊断是
A. 胃食管反流
B. 慢性胃炎
C. 十二指肠溃疡
D. 肠套叠
E. 先天性肥厚性幽门狭窄

正确答案：E。先天性肥厚性幽门狭窄

解析：患儿生后4周出现呕吐，呈喷射性，多发生于喂奶后半小时内，呕吐物不含胆汁，吐后食欲好，体重明显下降。最可能的诊断是先天性肥厚性幽门狭窄（E对）。胃食管反流（A错）呕吐为非喷射性，X线钡餐检查、食管24 小时pH监测等可协助确诊。慢性胃炎（B错）常见症状为反复发作、无规律性的腹痛（P213）。十二指肠溃疡（C错）表现为食欲差、呕吐、进食后啼哭、腹胀、生长发育迟缓（P215）。肠套叠（D错）表现为健康婴幼儿突然发生阵发性腹痛或阵发性规律性哭闹、呕吐、便血和腹部扪及腊肠样肿块。